女，62岁。膀胱炎病史多年，近期反复出现肉眼血尿。膀胱镜检查可见膀胱左侧乳头状肿瘤，大小1.5cm×1cm，有蒂，活组织病理检查为尿路上皮癌Ⅰ级。最适宜的治疗措施是
A. 放疗
B. 膀胱全切除术
C. 经尿道膀胱肿瘤电切术
D. 开放保留膀胱手术
E. 膀胱内药物灌注治疗

正确答案：C。经尿道膀胱肿瘤电切术

解析：患者老年女性，膀胱炎病史（膀胱慢性感染增加膀胱癌患病风险），近期反复肉眼血尿（膀胱癌最常见和出现最早症状）。膀胱镜检见膀胱左侧乳头状肿瘤（膀胱癌主要病理类型），活组织病理检查为尿路上皮癌Ⅰ级（分化良好），根据患者病史、临床表现、实验室检查，诊断为膀胱癌，尿路上皮癌Ⅰ级属于非肌层浸润性膀胱癌，Ta、T₁肿瘤，以经尿道膀胱肿瘤电切术（C对）为主要治疗方法（P570）。放疗适用于T₄期肌层浸润癌失去手术机会时的姑息治疗（A错）。膀胱全切术适用于原位癌细胞分化不良，癌旁原位癌或已有浸润并出现明显膀胱刺激症状时（B错）。开放保留膀胱手术（D错）适用于T₂期低级别、局限的肿瘤可。膀胱内药物灌注治疗（E错）多用于有转移的晚期病例，作为术前新辅助治疗和术后辅助治疗。